关于儿童龋病预防中窝沟封闭的操作，下列说法错误的是
A. 恒牙酸蚀的时间为20～30秒
B. 乳牙酸蚀的时间为60秒
C. 干燥牙面使用压缩空气吹干10～15秒
D. 自凝封闭剂涂布后1～2分钟自行固化
E. 光固化封闭剂的照射时间一般为60秒

正确答案：E。光固化封闭剂的照射时间一般为60秒

解析：本题考查窝沟封闭的操作方法与步骤。关于儿童龋病预防中窝沟封闭的操作，下列说法错误的是光固化封闭剂的照射时间一般为60秒（E错，为本题的正确答案）。窝沟封闭的操作方法与步骤：1.清洁牙面。2.酸蚀：清洁牙面后即用棉纱球或棉卷隔湿，将牙面吹干后用细毛刷、小棉球或小海绵块蘸上酸蚀剂放在要封闭的牙面上。酸蚀剂可为磷酸液或含磷酸的凝胶，酸蚀面积应大于接受封闭的范围，一般为牙尖斜面2/3。恒牙酸蚀的时间一般为20～30秒（A对），乳牙酸蚀60秒（B对）。3.冲洗和干燥：酸蚀后用水彻底冲洗，通常用水枪或注射器加压冲洗牙面10～15秒，边冲洗边用吸唾器吸干，去除牙釉质表面的酸蚀剂和反应产物。如用含磷酸的凝胶酸蚀，冲冼时间应加倍。冲洗后立即更换干棉球或干棉卷隔湿，随后用无油无水的压缩空气吹干牙面约15秒（C对），也可采用挥发性强的溶剂如无水酒精、乙醚辅助干燥。4.涂布封闭剂。5.固化：自凝封闭剂涂布后1～2分钟即可自行固化（D对）。光固化封闭剂涂布后，立即用可见光源照射。照射距离约离牙尖1mm，照射时间要根据采用的产品类型与可见光源性能决定，一般为20～40秒。照射的部位要大于封闭剂涂布的部位。6.检查。